由结缔组织、神经和血管组成的是
A. 牙质
B. 釉质
C. 牙骨质
D. 牙髓
E. 牙龈

正确答案：D。牙髓

解析：牙髓(D对)由结缔组织、神经和血管组成。